青年李某，男。因包茎到某医院做包皮环切术，在局部注射利多卡因后，即刻出现休克反应，经全力抢救无效后死亡。经专家会诊认为其死亡是利多卡因过敏所致，在临床中极为少见。根据《医疗事故处理条例》规定，李某的死亡后果，应当属于
A. —级医疗事故
B. 二级医疗事故
C. 三级医疗事故
D. 因不可抗力而造成的不良后果
E. 因患者体质特殊而发生的医疗意外

正确答案：E。因患者体质特殊而发生的医疗意外

解析：李某的死亡原因是利多卡因过敏，在临床中极为少见，属于患者体质特殊而发生的医疗意外（E对），不属于医疗事故。根据对患者人身造成的损害程度，医疗事故分为四级：一级医疗事故（A错）：造成患者死亡、重度残疾的；二级医疗事故（B错）：造成患者中度残疾、器官组织损伤导致严重功能障碍的；三级医疗事故（C错）：造成患者轻度残疾、器官组织损伤导致一般功能障碍的；四级医疗事故：造成患者明显人身损害的其他后果的。具体分级标准由国务院卫生行政部门制定（《医疗事故处理条例》）。